影响合理用药的外界因素涉及到
A. 国家卫生保健体制
B. 国家的药品政策
C. 企业的经营思想
D. 个人的道德观念
E. 国家的社会风气

正确答案：A、B、C、D、E。国家卫生保健体制；国家的药品政策；企业的经营思想；个人的道德观念；国家的社会风气